不属于促进慢性肾炎恶化因素的是
A. 肾脏基础病变活动
B. 高血压
C. 高蛋白饮食
D. 高脂血症
E. 遗传因素

正确答案：E。遗传因素

解析：促进慢性肾炎恶化的因素包括：①渐进性恶化的因素：高血糖、高血压（B对）、高蛋白饮食（C对）、蛋白尿、低蛋白血症、贫血、高脂血症（D对）、高同型半胱氨酸血症、老年、营养不良、尿毒症毒素（如甲基胍、甲状旁腺激素、酚类）、吸烟等；②急性恶化的因素：肾脏基础病变活动（累及肾脏的疾病复发或加重）（A对）、有效血容量不足、肾脏局部血供急剧减少、严重高血压未能控制、肾毒性药物、泌尿道梗阻、严重感染等。遗传因素（E错，为本题正确答案）不会促进慢性肾炎恶化。